我国法定职业病包括
A. 3大类90项
B. 9大类99项
C. 8大类98项
D. 10大类132种
E. 9大类103种

正确答案：D。10大类132种

解析：本题考查我国法定职业病的类型和种类。我国法定职业病包括10大类132种（D对ABCE错）：职业性尘肺病及其他呼吸系统疾病（19种）、职业性皮肤病（9种）、职业性眼病（3种）、职业性耳鼻喉口腔疾病（4种）、职业性化学中毒（60种）、物理性因素所致职业病（7种）、职业性放射性疾病（11种）、职业性传染病（5种）、职业性肿瘤（11种）及其他职业病（3种）。